2003年检查某班13岁学生50名。其中患龋病者30名，2年后再对这50名学生检查，发现其中10名学生有新的龋损，则这班学生2年龋病发病率为
A. 0.2
B. 0.3
C. 0.4
D. 0.5
E. 0.6

正确答案：A。0.2

解析：通常是指至少在一年时间内，某人群新发生龋病的频率。与患龋率不同的是仅指在这个特定时期内，新龋发生的频率。其计算公式。掌握“龋病流行病学”知识点。